不宜用煎煮法提取的中药化学成分是
A. 挥发油
B. 皂苷
C. 黄酮苷
D. 多糖
E. 蒽醌类

正确答案：A。挥发油

解析：本题考查的是煎煮法。不宜用煎煮法提取的中药化学成分是挥发油（A对）。煎煮法：是中药材加入水浸泡后加热煮沸，将有效成分提取出来的方法。此法简便，但含挥发性成分或有效成分遇热易分解的中药材不宜用此法。